女，28岁，失恋后出现哭笑无常，别人问她年龄，她说叔叔我三岁了。患者的症状属于
A. 虚构
B. 错构
C. 痴呆
D. 刚塞综合征
E. 童样痴呆

正确答案：E。童样痴呆

解析：患者成年女性，言行类似儿童，考虑为童样痴呆（E对）。虚构（A错）指在遗忘的基础上，患者以想象的、未曾亲身经历的事件来填补记忆的缺损。由于虚构患者有严重的记忆障碍，因而虚构的内容自己也不能再记住，所以其叙述的内容常常变化，且容易受暗示的影响。错构（B错）指在遗忘的基础上，患者对过去所历过的事件，在发生的地点、情节、特别是在时间上出现错误的回忆，并坚信不移。痴呆（C错）指智力发育成熟以后，由于各种原因损害原有智能所造成的智能低下状态。痴呆的发生往往具有脑器质性病变基础。刚塞综合征（D错）又称为心因性假性痴呆，表现为对简单问题给予近似而错误的回答，往往给人以故意或开玩笑的感觉。如当问患者牛有几条腿时，患者回答“3条腿”，对2+2=?的问题，则回答“等于5”，表明患者能理解问题的意义，回答内容切题，但不正确。